恶性淋巴瘤确诊依据为
A. 典型的临床表现
B. 淋巴结病理学诊断
C. 淋巴结穿刺
D. 影像学检查
E. 血清学检查

正确答案：B。淋巴结病理学诊断

解析：本题考查恶性淋巴瘤的诊断。恶性淋巴瘤确诊依据为淋巴结病理学诊断（B对）。恶性肿瘤的诊断金标准是病理学诊断，故恶性淋巴瘤的确诊依据为淋巴结病理学诊断。恶性淋巴瘤分类众多，临床表现多样，故不能以临床表现（A错）作为恶性淋巴瘤的确诊依据。淋巴结穿刺检查（C错）本身只能作为辅助检查方法，不能用于确诊，而且恶性淋巴瘤做穿刺可能会导致肿瘤的扩散。对恶性淋巴瘤，影像学检查（D错）及血清学检查（E错）都可辅助诊断，不能作为恶性淋巴瘤确诊依据。